不属于沉降性的功效是
A. 泻下
B. 清热
C. 解表
D. 止呕
E. 平喘

正确答案：C。解表

解析：本题考查的是升降沉浮的所示效用。解表多为升浮类药物的功效（C错，为本题正确答案）。升和浮、沉和降，都是相对的。升是上升，降是下降，浮表示发散向外，沉表示收敛固藏和泻利等。一般说，升浮类药能上行向外，分别具有升阳发表、祛风散寒、涌吐、开窍等作用；沉降类药能下行向内，分别具有泻下（A对）、清热（B对）、利水渗湿、重镇安神、潜阳息风、消积导滞、降逆止呕（D对）、收敛固涩、止咳平喘（E对）等作用。